属于医学伦理学研究的一门科学是
A. 医疗行为
B. 医学道德
C. 科研方法
D. 法律规范
E. 行为方式

正确答案：B。医学道德

解析：本题属于记忆类题目，医学道德属于医学伦理学研究的一门科学（B对）。